男，16岁，近半年对他人不关心，对自己的事情也不关心，对成绩下降感觉没关系，疏于自理卫生，对老师和家长的劝说也无所谓，属于
A. 情绪减退
B. 情绪缺失
C. 情绪障碍
D. 情绪淡漠
E. 情绪抑郁

正确答案：D。情绪淡漠

解析：患者男，16岁，近半年对他人不关心，对自己的事情也不关心，对成绩下降感觉没关系（对外界刺激缺乏相应的情感反应），疏于自理卫生，对老师和家长的劝说也无所谓，结合患者的表现，属于情绪淡漠（D对C错）。